男性，20岁。上前牙冷水刷牙时酸痛明显1个月余。无自发痛。口腔检查：左上2近中邻面深龋洞，冷刺激疼痛明显，刺激去除后疼痛即刻消失。牙髓活力电测验为一过性敏感反应，探诊无穿髓孔，叩诊（-），无松动，牙周检查（-）。最可能的诊断是
A. 可复性牙髓炎
B. 不可复性牙髓炎
C. 牙本质过敏症
D. 牙髓钙化
E. 牙髓坏死

正确答案：A。可复性牙髓炎

解析：本题考查可复性牙髓炎。男性，20岁。上前牙冷水刷牙时酸痛明显1个月余。无自发痛。口腔检查：左上2近中邻面深龋洞，冷刺激疼痛明显，刺激去除后疼痛即刻消失。牙髓活力电测验为一过性敏感反应，探诊无穿髓孔，叩诊（-），无松动，牙周检查（-）。最可能的诊断是可复性牙髓炎（A对）。不可复性牙髓炎的特点为自发性阵发性疼痛，患者无自发痛，排出不可复性牙髓炎（B错）。牙髓坏死无自发痛，牙冠变色，牙髓活力测验无反应（E错）。左上2近中邻面深龋洞，牙冠有明显缺损，冷刺激疼痛明显，牙髓钙化对温度测验的反应为异常，表现为迟钝或敏感（D错）。牙本质敏感主要表现为刺激痛，患牙往往对探、触等机械刺激和酸、甜等化学刺激更敏感，肉眼观察牙体形态一般无变化（C错）。